属于二肽基肽酶－4抑制剂的是
A. 阿卡波糖
B. 二甲双胍
C. 罗格列酮
D. 西格列汀
E. 格列吡嗪

正确答案：D。西格列汀

解析：本题考查西格列汀。西格列汀（D对）为二肽基肽酶－4抑制剂，可高选择性抑制二肽基肽酶-4，减小胰高糖素样肽-1的降解，延长其活性，促使胰岛素的分泌增加。阿卡波糖（A错）为α-葡萄糖甘酶抑制剂。二甲双胍（B错）为双胍类药，可增加基础状态下糖的无氧酵解，抑制肠道内葡萄糖的吸收，减少糖原生成和肝糖输出。罗格列酮（C错）属于胰岛素增敏剂。格列吡嗪（E错）为磺酰脲类促胰岛素分泌药。